张教授在对口腔医生进行上岗培训时，指出口腔医务人员发生口腔临床感染的主要危险来自于
A. 被污染器械刺伤
B. 操作后不洗手
C. 空气传播
D. 接触血液及唾液
E. 高速手机的飞沫

正确答案：A。被污染器械刺伤

解析：有研究报道牙科医生平均1年起码有1次被刺伤机会，研究表明针刺伤后乙型肝炎感染的危险性为20%～25%，因此，被污染器械刺伤是口腔医务人员临床感染的主要危险。掌握“患者、医务人员及环境的防护”知识点。